依据药物的性能，一般将止血药分为
A. 补虚止血药
B. 温经止血药
C. 凉血止血药
D. 化瘀止血药
E. 收敛止血药

正确答案：B、C、D、E。温经止血药；凉血止血药；化瘀止血药；收敛止血药

解析：本题考查止血药的分类。依据药物的性能，一般将止血药分为温经止血药（B对）、凉血止血药（C对）、化瘀止血药（D对）、收敛止血药（E对）。止血药按其性能功效及临床应用，常将本类药物分为凉血止血药、化瘀止血药、收敛止血药、温经止血药四类。